患者，右上7远中舌侧大面积龋坏缺损，已经进行根管治疗，原银汞充填物经常脱落，现要求全冠修复。检查：无叩痛，无松动，咬合距离正常，临床牙冠较高，不宜采用的修复方法是
A. 铸造金属全冠
B. 塑料全冠
C. 金属烤瓷全冠
D. 锤造金属全冠
E. 嵌体

正确答案：B。塑料全冠

解析：本题考查暂时修复与永久修复的制作方法。塑料全冠（B错，为本题的正确答案）易变色，磨损，脱落，多用于暂时性修复，不用于永久性修复。后牙咬合力大，患牙牙体组织缺损面积大，应选择耐磨，可承受较大咬合力的修复方法，如嵌体冠（E对）、铸造金属全冠（A对）、锤造金属全冠（D对）和金属烤瓷冠（C对）等。